蔬菜的春化作用是
A. 蔬菜打破休眠而发生发芽或抽薹变化
B. 重新分布蔬菜体内的养分，提高其营养价值
C. 在酶的参与下，在有氧存在下加速蔬菜中的有机物分解
D. 在蔬菜采摘后进一步成熟的过程
E. 蔬菜在春天发生的生理、生化、物理和化学变化

正确答案：A。蔬菜打破休眠而发生发芽或抽薹变化

解析：本题考查蔬菜的春化作用。蔬菜的春化作用是蔬菜打破休眠而发生发芽或抽薹变化（A对BCDE错），如马铃薯发芽、洋葱大蒜的抽薹等，这会大量消耗蔬菜体内的养分，使其营养价值降低。